霍乱的典型表现是
A. 黏液脓血便
B. 米泔水样便
C. 醉酒貌
D. 皮肤、巩膜黄染
E. 皮肤黏膜出血点

正确答案：B。米泔水样便

解析：霍乱肠毒素可刺激隐窝细胞分泌水、氯化物及碳酸氢盐的功能增强，同时抑制绒毛细胞对钠的正常吸收，以致大量水分和电解质聚集在肠腔，形成本病特征性的剧烈水样腹泻。霍乱肠毒素还能促使肠黏膜杯状细胞分泌黏液增多，使腹泻的水样便中含大量黏液。此外，腹泻导致的失水使胆汁分泌减少，因而腹泻排出的大便可呈"米泔水"样（B对）。黏液脓血便（A错）为急性细菌性痢疾典型的大便性状。醉酒貌（C错）为流行性出血热发热期全身毛细血管损伤的表现，其表现为颜面、颈部及上胸部呈弥漫性潮红，即"三红"征，似酒醉貌。皮肤、巩膜黄染（D错）为黄疸的典型表现；皮肤黏膜出血点（E错）为流行性脑脊髓膜炎的典型表现。